最能反映血液中红细胞和血浆相对数量变化的是
A. 血液黏滞性
B. 血细胞比容
C. 血浆渗透压
D. 血液比重
E. 血红蛋白量

正确答案：B。血细胞比容